按假药论处的药品是
A. 未标明有效期的药品
B. 擅自添加矫味剂的药品
C. 更改生产批号的药品
D. 超过有效期的药品
E. 变质的药品

正确答案：E。变质的药品

解析：《药品管理法》规定变质的药品属于假药（E对），而未标明有效期的药品（A错）、擅自添加矫味剂的药品（B错）、更改生产批号的药品（C错）、超过有效期的药品（D错）均属于劣药。